下列关于线粒体氧化磷酸化解偶联的叙述，正确的是
A. ADP磷酸化作用继续，氧利用增加
B. ADP磷酸化作用继续，但氧利用停止
C. ADP磷酸化停止，但氧利用继续
D. ADP磷酸化无变化，但氧利用停止
E. ADP磷酸化停止，氧的利用也停止

正确答案：C。ADP磷酸化停止，但氧利用继续